某垃圾场，一名男性垃圾焚烧工，在焚烧含大量塑料的垃圾时，突然感到头痛、头晕、发热，呼吸加快等不适而被送医院就诊，可诊断为
A. 氰化物中毒
B. 氮氧化物中毒
C. 聚合物烟雾热
D. 一氧化碳中毒
E. 中暑

正确答案：C。聚合物烟雾热